女婴，3个月。高热，频繁呕吐3天，嗜睡。查体：双眼凝视，反应差，脐部见少量脓性分泌物，前囟膨隆，心肺正常，脑膜刺激征（+）。错误的处理措施是
A. 抗生素治疗10～14天
B. 用药24小时内杀灭脑脊液中致病菌
C. 严密观察生命体征
D. 必要时可以应用肾上腺皮质激素
E. 腰穿降颅压

正确答案：E。腰穿降颅压

解析：患婴高热，脐部见少量脓性分泌物，提示体内有原发感染灶。患婴频繁呕吐、前囟膨隆，提示颅内压增高。患婴嗜睡、双眼凝视、反应差，应考虑化脓性脑膜炎，原发灶为脐部化脓性感染。该患儿的最可能的诊断为化脓性脑膜炎。对于化脓性脑膜炎合并颅内压增高者，不宜腰穿，否则易诱发脑疝危及患婴生命。即使因硬膜下积液量较大引起颅内压增高时，也应行硬膜下穿刺放出积液降压，而不是腰穿（E错，为本题正确答案）。其他选项都是化脑的治疗措施。